S-Ag可激活人体T细胞库中的克隆量大约为
A. 1%～10%或以上
B. 2%～20%或以上
C. 3%～30%或以上
D. 4%～40%或以上
E. 5%～50%或以上

正确答案：B。2%～20%或以上

解析：S-Ag可激活人体T细胞库中2%～20%或以上的克隆。掌握“抗原基本概念、分类、超抗原及佐剂”知识点。